如果肠系膜上动脉起始部发生血栓栓塞，造成血运障碍的所有肠段为
A. 十二指肠、空肠、回肠
B. 全部小肠和全部结肠
C. 全部小肠、盲肠和升结肠
D. 升结肠和横结肠
E. 降结肠、乙状结肠和直肠

正确答案：C。全部小肠、盲肠和升结肠

解析：肠系膜上动脉的分支有胰十二指肠下动脉、空肠动脉、回肠动脉、右结肠动脉和中结肠动脉，为全部小肠、盲肠、升结肠和部分横结肠提供血液供应。因此肠系膜上动脉起始部发生血栓栓塞后，造成血运障碍的所有肠段为全部小肠、盲肠、升结肠和部分横结肠（C对）。